甲状旁腺素对血钙的调节主要是通过
A. 肠和胃
B. 肝和胆
C. 胰和胆
D. 骨和肾
E. 脑垂体

正确答案：D。骨和肾

解析：甲状旁腺素（PTH）的总效应主要是升高血钙和降低血磷，其靶器官主要是肾与骨（D对）。对肾脏的作用PTH主要促进肾远曲小管和集合管重吸收Ca²⁺，减少钙的排泄，升高血钙。对骨的作用PTH可直接或间接作用于各种骨细胞，调节骨转换，既促进骨形成，又促进骨吸收。